糖尿病前期的诊断标准是空腹血糖
A. ＜6.1mmol/L
B. ＜7.8mmol/L
C. 6.1～7.0mmol/L
D. 7.8～11.0mmol/L
E. ≥11.0mmol/L

正确答案：C。6.1～7.0mmol/L